医疗机构发现发生或者可能发生传染病暴发流行时，应当
A. 在1小时内向所在地县级人民政府卫生行政主管部门报告
B. 在2小时内向所在地县级人民政府卫生行政主管部门报告
C. 在4小时内向所在地县级人民政府卫生行政主管部门报告
D. 在6小时内向所在地县级人民政府卫生行政主管部门报告
E. 在8小时内向所在地县级人民政府卫生行政主管部门报告

正确答案：B。在2小时内向所在地县级人民政府卫生行政主管部门报告

解析：根据《突发公共卫生事件应急条例》突发公共卫生事件监测机构、医疗机构及有关单位发现：①发生或可能发生传染病暴发流行的，②发生或可能发生不明原因群体疾病的，③发生或可能发生重大食物中毒或职业中毒的，④发生传染病菌种、毒种丢失的，都应在2小时内报当地政府卫生行政部门。掌握“突发公共卫生事件报告与法律责任”知识点。